关于椎管内复合麻醉，下列哪项不正确
A. 也称硬-腰联合麻醉
B. 能进行术后镇痛
C. 不能用于儿童和老年患者
D. 麻醉起效快
E. 阻止范围广

正确答案：C。不能用于儿童和老年患者

解析：硬-腰联合麻醉已成功地用于儿童及老年人等各年龄组的病人，故可以说椎管内复合麻醉能用于儿童和老年患者（C错，为本题正确答案）。将硬膜外阻滞麻醉与蛛网膜下腔阻滞麻醉结合在一起，称为椎管内复合麻醉，亦称为硬-腰联合麻醉（A对）。硬-腰联合麻醉综合了脊麻的起效快、阻滞完全、肌松良好、毒副作用小和硬膜外阻滞的时间可控性、可出现较广范围阻滞与能进行术后镇痛等优点（BDE对）。